当环境温度高于人体表温度时，机体主要的散热途径为
A. 对流
B. 蒸发
C. 辐射
D. 传导

正确答案：B。蒸发

解析：本题考查散热途径。环境温度发生变化时，经外周和中枢温度感受器的温度信息在下丘脑PO/AH体温调节中枢整合后，通过调节机体的产热和散热活动，来维持机体体温的相对恒定。机体与环境的热交换可以用以下的热平衡公式表示：S=M-E±R±C₁±C₂。其中，S为热蓄积的变化，M为代谢产热，E为蒸发散热，R为经辐射的获热或散热，C₁为对流的获热或散热，C₂为传导的获热或散热。皮肤是散热的主要部位，蒸发散热（B对ACD错）是最重要而有效的散热方式。